苯的沸点是80.1℃，易经呼吸道吸收
A. 脂/水分配系数与毒效应
B. 电离度与毒效应
C. 挥发度和蒸汽压与毒效应
D. 分散度与毒效应
E. 纯度与毒效应

正确答案：C。挥发度和蒸汽压与毒效应